少数病人用药后发生与遗传因素相关（但与药物本身药理作用无关）的有害反应属于
A. 继发性反应
B. 毒性反应
C. 特异质反应
D. 变态反应
E. 副作用

正确答案：C。特异质反应

解析：本题考查药品不良反应的分类。少数病人用药后发生与遗传因素相关（但与药物本身药理作用无关）的有害反应属于特异质反应（C对）。特异质反应是指因先天性遗传异常，少数患者用药后发生与药物本身的药理作用无关的有害反应。继发反应（A错）是继发于药物治疗作用之后的不良反应，是治疗剂量下治疗作用本身带来的间接结果。毒性反应（B错）是指在药物剂量过大或体内积蓄过多时发生的危害机体的反应。变态反应（D错）是指机体受药物刺激所引起的异常免疫反应，引起机体生理功能障碍或组织损伤。副作用（E错）是指在药物按照正常用法用量使用时，出现的与治疗目的无关的不适反应。